患者，女，55岁。干咳少痰，咳声嘶哑，口干咽燥，神疲，消瘦，手足心热，舌红少苔，脉细数。治疗应首选
A. 止嗽散
B. 桑菊饮
C. 桑杏汤
D. 二陈汤
E. 沙参麦冬汤

正确答案：E。沙参麦冬汤

解析：题中患者以干咳少痰为主症，故诊断为咳嗽。肺阴亏虚，虚热内灼，肺失润降，则干咳；虚火灼津为痰，肺损络伤，故痰少；阴虚肺燥，津液不能濡润上承，则咳声嘶哑，口干咽燥；阴虚火旺，故手足心热；阴精不能充养而神疲，消瘦；舌红少苔，脉细数均为阴虚内热之征，故诊断为咳嗽肺阴亏耗证，应滋阴润肺，化痰止咳，用沙参麦冬汤。（E对）止嗽散治疗咳嗽风寒袭肺证（A错）。桑菊饮治疗咳嗽风热犯肺证（B错）。桑杏汤治疗咳嗽风燥伤肺证（C错）。二陈汤治疗喘证痰浊阻肺证（D错）。